女，30岁，右肘关节外侧疼痛半年，查体：右侧Mills征阳性。X线检查未见异常。治疗和预防该病复发的关键是
A. 局部按摩
B. 功能锻炼
C. 早期手术
D. 限制腕关节活动
E. 药物治疗

正确答案：D。限制腕关节活动

解析：女性患者，右肘关节外侧疼痛半年，右侧Mills征阳性（肱骨外上髁炎典型体征），X线检查未见异常（排除骨折），故该患者最可能的诊断为右侧肱骨外上髁炎。肱骨外上髁炎是伸肌总腱起点处一种慢性损伤性疾病，治疗和预防该病复发的关键是限制腕关节活动（D对），减少慢性损伤。进行功能锻炼（B错）可加重病人的病情。大部分肱骨外上髁炎患者可通过局部按摩及药物等非手术治疗得到缓解，无须进行早期手术（C错），但局部按摩（A错）及药物治疗（E错）仅能缓解症状，不能预防该病复发。